具有镇静和减慢心率作用，对射击运动员参赛时禁用的药品是
A. 生长激素
B. 呋塞米
C. 麻黄碱
D. 普萘洛尔
E. 甲睾酮

正确答案：D。普萘洛尔

解析：本题考查普萘洛尔的药理作用。普萘洛尔（D对）为β受体阻滞剂，有镇静效果，能够降低血压、减慢心率、减少心肌耗氧量、增加人体平衡，射击运动员禁用。